休克期血中儿茶酚胺的含量
A. 高于正常
B. 低于正常
C. 接近正常
D. 可高可低
E. 以上都不是

正确答案：A。高于正常

解析：休克期即微循环淤血期，此期尽管交感－肾上腺髓质系统持续兴奋，血浆儿茶酚胺浓度高于正常（A对BCDE错），但微血管却表现为扩张。